腋外侧淋巴结位于
A. 胸外侧血管周围
B. 腋窝后壁
C. 腋窝中央
D. 腋血管周围
E. 腋静脉近段周围

正确答案：D。腋血管周围

解析：腋淋巴结均沿腋血管周围（D对）排列，外侧淋巴结沿腋静脉远侧段排列(E错）。